常用的有破伤风类毒素和白喉类毒素属于
A. 灭活疫苗
B. 减毒活疫苗
C. 类毒素疫苗
D. 亚单位疫苗
E. 偶联疫苗

正确答案：C。类毒素疫苗

解析：类毒素疫苗是采用经甲醛处理的细菌外毒素为抗原制成的疫苗。类毒素无毒性而保留了免疫原性，接种后能诱导机体产生抗毒素（外毒素的中和抗体）。常用的有破伤风类毒素和白喉类毒素。掌握“免疫预防及免疫治疗”知识点。